疾病主要累及的靶器官以非炎症性病理改变为主要特点的风湿病是
A. 骨性关节炎
B. 类风湿关节炎
C. 系统性红斑狼疮
D. 痛风
E. 干燥综合征

正确答案：A。骨性关节炎

解析：骨性关节炎的靶器官病变为关节软骨变性及软骨下骨质增厚、硬化，较少有炎症细胞浸润，属于非炎症性病变（A对）。类风湿关节炎（B错）的基本病理改变为滑膜炎和血管炎（P807），系统性红斑狼疮（C错）主要病理改变为炎症反应和血管异常（P816），痛风（D错）的病理表现为由于尿酸盐结晶沉积引起的炎症反应，干燥综合征（E错）主要表现为唾液腺炎和泪腺炎，因此B、C、D、E项均属炎症性病变。